DIC纤溶亢进期治疗时禁用
A. 肝素
B. 输新鲜血浆
C. 输新鲜全血
D. 氨基已酸
E. 输浓缩血小板

正确答案：A。肝素

解析：DIC（弥散性血管内凝血）分为三期，早期由于凝血酶激活，微血栓形成，机体处于高凝状态；中期由于凝血因子大量消耗，机体处于消耗性低凝状态；晚期可继发纤溶亢进。DIC纤溶亢进期应采用氨基已酸（D错）等纤溶抑制药物，禁忌使用肝素（A对），以免加重出血；输新鲜血浆（P627）（B错）主要用于消耗性低凝期的治疗，以补充凝血因子；输新鲜全血（C错）可用于休克的治疗；输浓缩血小板（P627）（E错）主要用于血小板减少患者，以预防出血；BCE均不是DIC纤溶亢进期的治疗禁忌。